成熟恒牙根管充填下列哪项是不允许的
A. 根充材料距根尖0.5～1.0mm左右
B. 根充材料距根尖4mm以上
C. 少量糊剂超充牙胶尖恰填
D. 牙胶尖紧密堵塞根尖孔
E. 采用银尖等硬性材料

正确答案：B。根充材料距根尖4mm以上

解析：本题考查根管充填质量的评价。成熟恒牙根管充填，根充材料距根尖4mm以上（B错，为本题的正确答案）是不允许的。X线片显示充填物到达距根尖0.5～2mm即根尖止点的位置为恰填（A对），不足或充填物不致密者为欠填，超出者为超填，根尖材料距根尖4mm以上是明显的欠填，桩核冠修复要求根尖区保留4mm的根充材料。根管治疗要求保证两端封闭的严密程度，即根尖孔和冠部入口，也就是说充填物要紧密封闭根尖孔（D对）。少量糊剂超充是可以吸收的，牙胶尖要保证不能欠填也不能超填，否则会影响根尖炎症的消退（C对）。采用银尖等硬性材料便于充填（E对）。